位于舌侧缘后部呈片形的粘膜皱襞
A. 丝状乳头
B. 轮廓乳头
C. 舌扁桃体
D. 菌状乳头
E. 叶状乳头

正确答案：E。叶状乳头

解析：叶状乳头(E对)为位于舌侧缘后部呈片形的粘膜皱襞。